下列哪项不是中小学校在课桌椅卫生管理要求
A. 遵循课桌与课椅同号搭配的原则
B. 最前排课桌前沿与黑板距离至少要有2m
C. 最后排课桌后沿与黑板距离小学不大于8m，中学不大于10m
D. 少数学生无匹配号码，可遵循就大不就小的原则
E. 身高低的在前，高的在后

正确答案：C。最后排课桌后沿与黑板距离小学不大于8m，中学不大于10m